下述结构中，何者不从腕管通过
A. 指浅屈肌腱
B. 指深屈肌腱
C. 拇长屈肌腱
D. 掌长肌腱
E. 正中神经

正确答案：D。掌长肌腱

解析：指浅屈肌腱（A对）、指深屈肌腱（B对）、拇长屈肌腱（C对）和正中神经（E对）均从腕管通过，而与掌长肌腱（D错，为本题正确答案）无关。